出血是肝素最常见的不良反应，对明显出血者选用的特异性拮抗药是
A. 氟马西尼
B. 鱼精蛋白
C. 地塞米松
D. 烯丙吗啡
E. 酚磺乙胺

正确答案：B。鱼精蛋白

解析：本题考查鱼精蛋白。鱼精蛋白（B对）带有正电荷，可与肝素结合形成稳定的复合物，使肝素失去抗凝血作用。氟马西尼（A错）用于苯二氮䓬类药物及乙醇中毒的解救。地塞米松（C错）是抗炎、抗过敏药物。烯丙吗啡（D错）用于抢救吗啡、哌替啶等的急性中毒。酚磺乙胺（E错）是临床上常用的止血药,也可以预防术后出血，但不能特异拮抗肝素的抗凝作用。